下列偏倚不属于选择偏倚的是
A. 入院率偏倚
B. 奈曼偏倚
C. 检出症候偏倚
D. 测量偏倚
E. 无应答偏倚

正确答案：D。测量偏倚